脂质过氧化可以引起
A. 细胞膜的液态性增高
B. 细胞膜的流动性增高
C. 细胞膜的脆性增高
D. 细胞膜的稳定性增高
E. 细胞膜的通透性降低

正确答案：C。细胞膜的脆性增高

解析：细胞及细胞器膜结构破坏：脂质过氧化使膜不饱和脂肪酸减少，以致不饱和脂肪酸／蛋白质的比例失调；细胞膜及线粒体、溶酶体等细胞膜的液态性降低（A错）、细胞膜的流动性降低（B错）及细胞膜的通透性升高（E错），可使细胞外Na+与Ca2+内流增加，引起细胞水肿及钙超载，细胞膜的稳定性降低（D错）。细胞膜的脆性增高（C对）是脂质过氧化引起的。